位于舌盲孔前方、局限性真菌感染的是
A. 地图舌
B. 叉舌
C. 沟纹舌
D. 菱形舌
E. 光滑舌

正确答案：D。菱形舌

解析：在舌盲孔前方，有时见到小块菱形或椭圆形的红色区域，舌乳头呈不同程度的萎缩，称菱形舌。以前认为这是奇结节遗留所形成的，对健康无害，但近年来的研究证实菱形舌与局限性真菌感染，特别是白色念珠菌感染有关。掌握“腭部与舌的发育”知识点。